病原体在外环境中停留和转移所经历的全过程称为
A. 传播过程
B. 传播机制
C. 传染过程
D. 传播途径

正确答案：D。传播途径

解析：本题考查传播途径的概念。传播途径（D对ABC错）是指病原体从传染源排出后，侵入新的易感宿主前，在外环境中所经历的全过程。